A综合医院已取得《麻醉药品、第一类精神药品购用印鉴卡》。注册在A综合医院的执业医师甲，患有癌症，在本院欲为自己开具吗啡针剂。关于A综合医院《麻醉药品、第一类精神药品购用印鉴卡》的说法，正确的是
A. 综合医院须凭《麻醉药品、第一类精神药品购用印鉴卡》向本省（区、市）范围内的定点批发企业购买麻醉药品
B. 《麻醉药品、第一类精神药品购用印鉴卡》有效期为5年
C. A综合医院向市级药品监督管理部门提出办理《麻醉药品、第一类精神药品购用印鉴卡》
D. A综合医院麻醉药品、第一类精神药品处方资格的执业医师变更应当到市级卫生行政部门办理变更手续

正确答案：A。综合医院须凭《麻醉药品、第一类精神药品购用印鉴卡》向本省（区、市）范围内的定点批发企业购买麻醉药品

解析：本题考查印鉴卡管理。A综合医院已取得《麻醉药品、第一类精神药品购用印鉴卡》。注册在A综合医院的执业医师甲，患有癌症，在本院欲为自己开具吗啡针剂。关于A综合医院《麻醉药品、第一类精神药品购用印鉴卡》的说法，正确的是综合医院须凭《麻醉药品、第一类精神药品购用印鉴卡》向本省（区、市）范围内的定点批发企业购买麻醉药品（A对）。印鉴卡管理：根据《麻醉药品和精神药品管理条例》，为加强对医疗机构购用麻醉药品和第一类精神药品的管理，防止麻醉药品和第一类精神药品流入非法渠道，保证医疗需求，原卫生部制定了《〈麻醉药品、第一类精神药品购用印鉴卡〉管理规定》（卫医发〔2005〕421号）并于2005年11月2日发布。医疗机构应当凭《印鉴卡》向本省（区、市）行政区域内的定点批发企业购买麻醉药品和第一类精神药品。1.取得《印鉴卡》的必备条件：医疗机构向设区的市级卫生行政部门提出办理《印鉴卡》（C错），应当具备下列条件。（1）有与使用麻醉药品和第一类精神药品相关的诊疗科目。（2）具有经过麻醉药品和第一类精神药品培训的、专职从事麻醉药品和第一类精神药品管理的药学专业技术人员。（3）有获得麻醉药品和第一类精神药品处方资格的执业医师。（4）有保证麻醉药品和第一类精神药品安全储存的设施和管理制度。2.《印鉴卡》有效期为3年（B错）。《印鉴卡》有效期满前3个月，医疗机构应当向市级卫生行政部门重新提出申请。《印鉴卡》有效期满需换领新卡的医疗机构，还应当提交原《印鉴卡》有效期期间内麻醉药品、第一类精神药品使用情况。3.当《印鉴卡》中医疗机构名称、地址、医疗机构法人代表（负责人）、医疗管理部门负责人、药学部门负责人、采购人员等项目发生变更时，医疗机构应当在变更发生之日起3日内到市级卫生健康主管部门办理变更手续。4.市级卫生行政部门自收到医疗机构变更申请之日起5日内完成《印鉴卡》变更手续，并将变更情况抄送所在地同级药品监督管理部门、公安机关，报省级卫生行政部门备案。医疗机构应当将具有麻醉药品和第一类精神药品处方资格的执业医师名单及其变更情况，定期报送所在地设区的市级卫生行政部门，并抄送同级药品监督管理部门（D错）。